中枢性尿崩症患者控制多尿最适宜的药物是
A. 去氨加压素
B. 卡马西平
C. 氢氯噻嗪
D. 氯磺丙脲
E. 地美环素

正确答案：A。去氨加压素

解析：中枢性尿崩症患者，抗利尿激素（AVP，精氨酸加压素）的合成、转运、储存及释放受到影响，导致其血中AVP浓度下降。由于其尿量增多的原因为精氨酸加压素缺乏，因此为控制多尿应补充精氨酸加压素或其类似物。去氨加压素（A对）为人工合成的加压素类似物，其抗利尿作用强，而无加压作用，不良反应少，为目前治疗尿崩症的首选药物。氢氯噻嗪（C错）为肾性尿崩症的主要治疗药物，可用于中枢性尿崩症，但效果不如去氨加压素好。非激素类抗利尿药物如卡马西平（B错）、氯磺丙脲（D错），能刺激AVP释放并增强AVP对肾小管的作用，但其作用效果不及去氨加压素。地美环素（E错）为半合成的四环素类抗生素，对中枢性尿崩症治疗无效。